月经失调不孕症患者不常用的治疗方法是
A. 外治疗法
B. 一般治疗
C. 中药人工周期
D. 西药人工周期
E. 促排卵

正确答案：A。外治疗法

解析：月经失调性不孕症，是指妇女长期月经错乱，夫妇同居3年以上不受孕者。月经失调不孕症常见治疗方法有：（1）一般疗法（B对）。（2）中药人工周期疗法（C对），是指以月经阶段分期立法，可以是全周期或半周期调治，所用药材会根据病人体质和病情灵活选择，化裁，适合所有的月经病调治，常用治疗功能性子宫出血、痛经、子宫内膜异位症、功能性不孕或闭经等。（3）西药人工周期疗法（D对），是指模拟自然月经周期卵巢的内分泌变化，将雌、孕激素序贯或合并应用，使子宫内膜发生相应变化，引起周期性脱落。（4）促排卵（E对）是指用排卵药治疗由于丘脑下部——垂体——卵巢轴功能失调而无排卵且引起的无月经、月经稀发、功血等所致不孕证，服用药物可诱发排卵。外治疗法，一般指采用中药制剂，通过皮肤的渗透吸收，进入内脏有病部位，达到治疗的目的，外治疗法，主要包括熏洗法、冲洗法、纳药法、帖敷法（A错，为本题正确答案）。